染色体断裂后不重接则不能形成下列哪种形态学改变
A. 无着丝粒断片
B. 染色体缺失
C. 环状染色体
D. 微核

正确答案：C。环状染色体

解析：本题考查染色体断裂的相关内容。染色体断裂后不重接则可形成无着丝粒断片（A对）、染色体缺失（B对）、微核（D对）等。环状染色体是染色体两臂各发生一次断裂，重接形成环状结构。染色体断裂后不重接则不能形成环状染色体（C错，为本题正确答案）。